下列哪个部位的溃疡应特别注意Zollinger-Ellison综合征的可能性
A. 胃窦部
B. 幽门管
C. 十二指肠球部
D. 十二指肠降部
E. 回肠远端

正确答案：D。十二指肠降部

解析：Zollinger-Ellison综合征由促胃液素瘤或促胃液素细胞增生所致，促胃液素刺激壁细胞分泌大量胃酸，引起顽固性多发性异位溃疡，溃疡常位于十二指肠球部和胃窦部，其余分布于食管下段、十二指肠球后（十二指肠降部与水平部）（D对）及空肠等非典型部位。其中十二指肠球部（C错）为十二指肠溃疡的好发部位，胃窦部（A错）是胃癌的好发部位，均不具有特异性。幽门管（B错）为幽门管溃疡好发部位，回肠远端（E错）为非特异性孤立性小肠溃疡的好发部位，与Zollinger-Ellison综合征无关。